患儿1岁半，发热4天，热退后全身出现红色斑丘疹。其诊断是
A. 风疹
B. 幼儿急疹
C. 猩红热
D. 麻疹
E. 水痘

正确答案：B。幼儿急疹